除另有规定外，需检查黏附力的制剂是
A. 贴膏剂
B. 软膏剂
C. 膏药
D. 膜剂
E. 乳膏剂

正确答案：A。贴膏剂

解析：本题考查的是贴膏剂的质量要求。除另有规定外，需检查黏附力的制剂是贴膏剂（A对）。贴膏剂的黏附力：除另有规定外，凝胶贴膏和橡胶贴膏按《中国药典》黏附力测定法测定，均应符合各品种项下的规定。贴膏剂的含膏量、耐热性、赋形性、黏附力、含量均匀度、微生物限度等应符合相关规定。软膏剂（B错）的抑菌效力、粒度、装量、无菌、微生物限度等应符合相关规定。膏药（C错）的软化点、重量差异等应符合《中国药典》规定。乳膏剂（E错）的抑菌效力、装量、无菌、微生物限度等应符合相关规定。膜剂（D错）的质量要求，2022年考试指南未明确说明。